为莨菪碱类药物，天然品为左旋体（称654-1），合成品为（称654-2），临床上用于解痉的药物是
A. 硫酸阿托品
B. 氢溴酸山莨菪碱
C. 丁溴东莨菪碱
D. 氢溴酸东莨菪碱
E. 溴丙胺太林

正确答案：B。氢溴酸山莨菪碱

解析：本题考查氢溴酸山莨菪碱。氢溴酸山莨菪碱（B对）是莨菪碱类药物，其天然品是左旋体（称654-1），合成品是外消体称652-2，有抗M胆碱作用，临床上常用来解痉。阿托品（A错）无旋光性。丁溴东莨菪碱（C错）含季铵结构，本身具有左旋性。东莨菪碱（D错）结构具有左旋性。抗胆碱药溴丙胺太林（E错）无旋光性。